《药品经营质量管理规范实施细则》规定，药品零售连锁店的相关人员及营业员进行健康检查的周期是
A. 每季
B. 每半年
C. 每年
D. 每2年
E. 每3年

正确答案：C。每年

解析：本题考查健康管理。《药品经营质量管理规范实施细则》规定，药品零售连锁店的相关人员及营业员进行健康检查的周期是每年（C对）。质量管理、验收、养护、储存等直接接触药品岗位的人员应当进行岗前及年度健康检查，并建立健康档案。患有传染病或者其他可能污染药品的疾病的，不得从事直接接触药品的工作。身体条件不符合相应岗位特定要求的，不得从事相关工作。